天花粉的特征为
A. 药材断面白色，粉性
B. 药材横断面可见黄色小孔呈放射状排列
C. 二者均是
D. 二者均非

正确答案：C。二者均是

解析：本题考查的是天花粉药材的性状鉴别。天花粉的特征为药材断面白色，粉性与药材横断面可见黄色小孔呈放射状排列（C对）。天花粉：【性状鉴别】药材呈不规则圆柱形、纺锤形或瓣块状。表面黄白色或淡棕黄色，有纵皱纹、细根痕及略凹陷的横长的皮孔；有的有黄棕色外皮残留。质坚实，断面白色或淡黄白色，富粉性（A错），横切面可见黄色小孔（导管），略呈放射状排列（B错），纵切面可见黄色条纹状木质部。气微，味微苦。